下列哪一项不符合恶性淋巴瘤的治疗原则
A. 早期HL的治疗以化学药物治疗为主
B. NHL的疗效比HL差
C. NHL以化疗为主，放疗为辅
D. 对低度恶性、预后好的NHL，5年生存率约为70%～80%
E. NHL由于容易全身播散

正确答案：A。早期HL的治疗以化学药物治疗为主

解析：霍奇金淋巴瘤早期HL的治疗以放射治疗为主，近年来扩大放射野照射和提高放射剂量后，疗效有所提高。对于晚期HL，多应用化学药物治疗，常用的化疗方案为MOPP（氮芥、长春新碱、丙卡巴肼、泼尼松），有较好的疗效。但目前仍以放疗与化疗合用为好。掌握“恶性淋巴瘤”知识点。